与粗出生率计算公式分母相同的指标是
A. 婴儿死亡率
B. 新生儿死亡率
C. 粗死亡率
D. 总生育率
E. 生存率

正确答案：C。粗死亡率

解析：婴儿死亡率：同年未满1岁婴儿死亡数/某年活产总数
新生儿死亡率：同年未满28天的新生儿死亡数/某年活产总数
粗死亡率：同年死亡总数/某年平均人口数
出生率：同年活产总数/某年平均人口数
生育率：同年活产数/某年15-49育龄妇女数